香加皮的基原植物杠柳属于
A. 蓼科
B. 芸香科
C. 萝藦科
D. 忍冬科
E. 唇形科

正确答案：C。萝藦科

解析：本题考查的是香加皮的来源。香加皮的基原植物杠柳属于萝藦科（C对）。香加皮：【来源】为萝藦科植物杠柳的干燥根皮。来源于蓼科（A错）的中药有大黄、虎杖、何首乌、蓼大青叶等。来源于芸香科（B错）的中药有黄柏、关黄柏、白鲜皮、枳壳、吴茱萸等。来源于忍冬科（D错）的中药有金银花、山银花等。来源于唇形科（E错）的中药有丹参、黄芩、紫苏叶、广藿香、荆芥、益母草、薄荷、半枝莲、香薷等。